患者，男，60岁。咳嗽，吐痰，反复发作5年，近1周症状加重。检查：体温正常，两肺散在干、湿性啰音，血白细胞11.0×109/L，中性粒细胞0.8。首先考虑的是
A. 急性支气管炎
B. 慢性支气管炎急性发作
C. 肺结核
D. 支气管哮喘
E. 肺癌

正确答案：B。慢性支气管炎急性发作

解析：本患者中老年男性，反复咳嗽、咳痰5年，可考虑为慢性支气管炎，患者两肺散在干、湿性啰音，血白细胞白细胞增高，中性粒细胞增高，提示肺部感染，故患者首先考虑的诊断是慢性支气管炎急性发作（B对）。急性支气管炎（P17）（A错）起病较急，全身症状较轻，可有发热，咳嗽、咳痰可延续2～3周。肺结核（P65）（C错）主要表现为咳嗽、咳痰或痰中带血，伴有乏力、低热、盗汗等。支气管哮喘（P30）（D错）主要表现为发作性伴有哮鸣音的呼气性呼吸困难。肺癌（P78）（E错）主要表现为咳嗽、痰血或咯血、气短或喘鸣、发热、体重下降。